瘢痕性类天疱疮在口腔任何部位均可发生，发生率最高的部位是
A. 牙龈
B. 软腭
C. 硬腭
D. 舌
E. 颊部黏膜

正确答案：A。牙龈

解析：本题考查瘢痕性类天疱疮发生率最高的部位。瘢痕性类天疱疮的损害可发生于口腔黏膜的任何部位，但牙龈（A对）最为多见，其次为硬腭（C错）和颊部（E错），损害很少发生在软腭（B错）和舌（D错）。牙龈最典型的表现呈剥脱性龈炎样损害。损害早期在龈缘及附着龈有弥散性红斑，其上常见直径2～6mm水疱。